男，11岁，因牙齿排列不齐要求正畸治疗，检查见前牙拥挤，适于观察混合牙列乳恒牙交替情况的是
A. 曲面体层
B. 上颌侧位体层
C. 上颌后前位体层第一磨牙层
D. 上颌后前位体层翼突层
E. 下颌体腔

正确答案：A。曲面体层

解析：本题考查曲面体层摄影检查。全口牙位曲面体层片（A对）可以在一张胶片上显示全口牙齿、双侧上下颌骨、上颌窦及颞下颌关节等，可以清晰地显示混合牙列乳恒牙及牙胚的位置，数目和发育情况，适用于观察混合牙列乳恒牙交替情况。上颌侧位体层（B错）常用于检查上颌骨、上颌窦、翼腭窝及颞下颌窝病变。上颌后前位体层第一磨牙层（C错）常用于观察上颌病变及其与上颌窦、筛窦、眶底、鼻腔和颅底的关系。上颌后前位体层翼突层（D错）常用于观察上颌肿瘤是否累及翼突及颅底。下颌体腔位（E错）多用于观察下颌的病损，不能全面观察混合牙列乳恒牙交替情况。